不是由于容量负荷过重所致心力衰竭的疾病是
A. 主动脉瓣关闭不全
B. 肺动脉高压
C. 二尖瓣关闭不全
D. 室间隔缺损
E. 动静脉瘘

正确答案：B。肺动脉高压

解析：主动脉瓣关闭不全（A对）在舒张期，主动脉内大量血流反流入左心室，使左心室舒张末期容量增加，最终发生左心功能不全。肺动脉高压（B错，为本题正确答案），各种原因导致的肺动脉压力异常升高，使右心室收缩期射血阻力增加，压力负荷（后负荷）过重导致右心衰，而非容量负荷。二尖瓣关闭不全（C对）时左心室舒张期容量负荷增加，在代偿早期，通过Frank-Starling机制可使左心室每搏量增加，射血分数维持在正常范围，左心室舒张末容量和压力可不增加；当失代偿时，每搏量和射血分数下降，肺静脉和肺毛细血管楔压增高，继而发生肺淤血、左心室衰竭。室间隔缺损（D对）导致血流在心室水平从左向右分流，使肺循环血量增大、左心室容量负荷增大，最终导致心力衰竭。动静脉瘘（E对）动脉血流经瘘口分流及远端动脉缺血，促使心率增快以维持有效周围循环，回心血量增加，导致容量负荷过重，最终导致心力衰竭。